常用个人防护用品不包括
A. 手套
B. 含氟漱口水
C. 口罩
D. 面罩
E. 工作服

正确答案：B。含氟漱口水

解析：本题考查个人防护用品。常用个人防护用品不包括含氟漱口水（B错，为本题的正确答案）。任何口腔诊疗过程至少会接触口腔黏膜、唾液以及接触患者使用过的器械。个人防护用品（PPE）是医护人员为预防和控制感染所穿戴的自我保护用品，是控制感染最基本的要求。常用的PPE包括手套（A对）、口罩（C对）、面罩（D对）、防护眼镜、工作服（E对）和工作帽。